某男，26岁。咳嗽3日，症见干咳、连声作呛、喉痒干痛、唇鼻干燥、痰少而黏、不易咯出、心烦口渴，舌红干而少津、苔薄白、脉浮数。证属风燥伤肺、肺失清润。治以疏风清肺、润燥止咳。处方：桑叶9g、薄荷3g、苦杏仁9g、南沙参9g、天花粉10g、浙贝母9g、芦根10g、前胡10g、炒牛蒡子10g、淡豆豉10g、桔梗5g，7剂，每日1剂，水煎服。方中选用南沙参而未用北沙参，此因南沙参除能清肺养阴外，又能
A. 敛肺
B. 祛痰
C. 止咳
D. 散风
E. 滋肾

正确答案：B。祛痰

解析：本题考查南沙参的功效。方中选用南沙参而未用北沙参，此因南沙参除能清肺养阴外，又能祛痰（B对）。南沙参【功效】清肺养阴，祛痰，益气。乌梅【功效】敛肺（A错），涩肠，生津，安蛔，止血。侧柏叶【功效】凉血止血，祛痰止咳（C错），生发乌发。荆芥【功效】散风（D错）解表，透疹止痒，止血。女贞子【功效】滋肾（E错）补肝，清虚热，明目乌发。